丙酮酸氧化脱羧生成的物质是
A. 丙酰CoA
B. 乙酰CoA
C. 羟甲戊二酸CoA
D. 乙酰乙酸CoA
E. 琥珀酸CoA

正确答案：B。乙酰CoA

解析：本题考查糖的有氧氧化的三个阶段。丙酮酸氧化脱羧生成的物质是乙酰CoA（B对A错）。羟甲戊二酸CoA（C错）由乙酰乙酰CoA与乙酰CoA缩合而成，可见于酮体生成过程。乙酰乙酸CoA（D错）可由2分子乙酰CoA缩合而成，可见于酮体生成过程。琥珀酸CoA（E错）可由α-酮戊二酸氧化脱羧生成，可见于三羧酸循环。